能有效地防止和逆转心衰患者的心肌重构的药物是
A. 地高辛
B. 多巴酚丁胺
C. 米力农
D. 氢氯噻嗪
E. 依那普利

正确答案：E。依那普利

解析：本题考查依那普利。依那普利（E对）为血管紧张素转换酶抑制剂，对心力衰竭者可增加左室射血分数和心脏指数，延缓血管壁和心室壁肥厚，防止和逆转患者的血管壁和心肌细胞增生肥大。地高辛（A错）能够增强心肌收缩力，为心力衰竭辅助用药。多巴酚丁胺（B错）主要用于器质性心脏病时心肌收缩力下降引起的心力衰竭。米力农（C错）主要用于对洋地黄、利尿剂、血管扩张剂治疗无效或欠佳的急、慢性顽固性充血性心力衰竭。氢氯噻嗪（D错）为常用的利尿药。